下颌第一乳磨牙牙冠解剖形态中哪一点是错误的
A. 颊面虽为四边形，但近中缘长直，远中缘特短且突
B. 形态不似任何恒磨牙
C. 远中舌尖长而尖，近中舌尖短而小
D. 近中颊尖大于远中颊尖，近中颊颈嵴最突
E. 牙根分为近远中

正确答案：C。远中舌尖长而尖，近中舌尖短而小

解析：本题考查下颌第一乳磨牙牙冠解剖形态。远中舌尖长而尖，近中舌尖短而小（C错，为本题正确答案）不符合下颌第一乳磨牙牙冠解剖特点。下颌第一乳磨牙舌面近远中缘的长度相近，颈缘较直。近中舌尖长而尖，远中舌尖短小而圆，两舌尖之间有沟。下颌第一乳磨牙是唯一一颗不类似任何恒牙的乳牙（B对）。其颊面为四边形，但近中缘长且直，远中缘特短且突（A对），类似以近中缘为底的三角形。近中颊尖大于远中颊尖，两颊尖之间有沟，近中颈嵴最突（D对）。邻面近中面颊侧缘颈1/3处颈嵴突出明显，牙合1/3明显缩窄，颊、舌尖相距很近，近似以颈缘为底的三角形。远中面较近中面圆突。牙合面有4个牙尖，其中近中颊尖最大，近中舌尖次之，远中颊尖很小。牙根一般为近中及远中两根（E对），根干较短，根分叉大。